若患儿夜间发生尖锐的剧烈自发痛，影响睡眠，冷热刺激可加重疼痛，可以诊断为
A. 急性牙髓炎
B. 慢性溃疡性牙髓炎
C. 慢性增生性牙髓炎
D. 牙髓钙化
E. 牙髓坏死

正确答案：A。急性牙髓炎

解析：急性牙髓炎的诊断可根据疼痛的特征，如较尖锐或较剧烈的自发痛，影响患儿睡眠，冷热刺激可引起或加重疼痛，牙齿有龋洞或者充填物等。如痛侧有好几个可疑患牙时，应注意检查，确定急性牙髓炎的患牙，以便立即解除患儿疼痛。掌握“乳牙牙髓病及根尖周病诊断及治疗”知识点。